麻疹粘膜斑一般见于发热的什么时间
A. 之前
B. 第2~3天
C. 第4~6天
D. 第7~9天
E. 退热后

正确答案：B。第2~3天

解析：麻疹发热第2~3天可见麻疹粘膜斑（B对）。发热之前见不到麻疹粘膜斑（A错）。第4~6天麻疹粘膜斑已开始消退或已退尽（C错）。第7天以后已进入疹退期，不可能见到麻疹粘膜斑（D错）。退热后，邪毒已透，胃纳转佳，精神转安，脉静身凉，不可见麻疹粘膜斑（E错）。